药物的首过消除发生于
A. 舌下给药后
B. 吸入给药后
C. 口服给药后
D. 静脉给药后
E. 皮下给药后

正确答案：C。口服给药后

解析：口服给药是常用的给药方式，其吸收部位在胃肠道，受多种因素的影响，某些药物口服给药后（C对）受首关效应的影响，即药物首次通过肠壁或肝脏时被其中的酶所代谢，进入体循环的药量减少，药效降低，所以首关效应明显的药物不宜口服，如硝酸甘油，首过灭活约95%，因此多采用舌下含服。舌下给药（A错）血流丰富，吸收较快，并且该处药物可经舌下静脉，不经肝脏而直接进入体循环，避免首关效应，因此破坏少，药理作用较快。吸入给药（B错）可产生局或全身的治疗作用，同时肺泡面积很大，肺血流量丰富，因此，肺部给药能迅速吸收，吸收后的药物直接进入血液循环，不经肝脏首过效应。静脉给药（D错）起效最快，不经吸收直接进入血液循环，无肝脏的首过代谢。皮下给药后（E错）时，药物先沿结缔组织扩散，再经毛细血管和淋巴内皮细胞进入血液循环，无首关效应。